采用水溶性基质制备栓剂的融变时限是
A. 15分钟
B. 30分钟
C. 45分钟
D. 60分钟
E. 90分钟

正确答案：D。60分钟

解析：本题考查栓剂的融变时限。除另有规定外，照融变时限检查法（药典通则0922）检查，应符合规定。取栓剂3粒，在室温放置1小时后，脂肪性基质的栓剂应在30分钟（B错）内全部融化或软化变形，水溶性基质的栓剂应在60分钟（D对）内全部溶解。